肾上腺皮质激素类药物可局部注射于
A. 结核性溃疡
B. 雪口病
C. 腺周口疮
D. 疱疹性口炎
E. 以上均不对

正确答案：C。腺周口疮

解析：本题考查复发性阿弗他溃疡的治疗方法。腺周口疮（C对）即重型复发性阿弗他溃疡（MaRAU），对经久不愈或疼痛明显的MaRAU，可作局部封闭，用曲安奈德（肾上腺皮质激素类药物）混悬液加等量的2％利多卡因液，每1～2周局部封闭一次。结核性溃疡（A错）和疱疹性口炎（D错）禁止使用肾上腺皮质激素类药物，以免病毒扩散产生严重后果。雪口病（B错）的病原菌为白色念珠菌，常用药物为碳酸氢钠溶液，不使用肾上腺皮质激素类药物进行局部注射治疗。